下列哪项不是毛状白斑的临床表现
A. 多为双侧发生
B. 主要在舌缘、舌腹
C. 表面有毛状突起
D. 可以擦掉
E. 一般无自觉症状

正确答案：D。可以擦掉

解析：口腔毛状白斑：约30%HIV感染者在病程中出现口腔毛状白斑。损害多见于双侧舌侧缘黏膜，可延伸至舌背部或舌腹部黏膜。损害呈白色皱褶隆起，不可擦去。多见于男性。毛状白斑现已被广泛认同是艾滋病感染者的一种特殊口腔损害，对艾滋病发生有高度提示性，其他疾病很少出现毛状白斑。掌握“艾滋病的口腔表征”知识点。